在X线片上表现为颌面骨广泛性或局限性沿骨长轴方向发展，呈不同程度的弥散性膨胀，可呈毛玻璃状
A. 骨化纤维瘤
B. 骨纤维异样增殖症
C. 成釉细胞瘤
D. 牙源性角化囊性瘤
E. 组合性牙瘤

正确答案：B。骨纤维异样增殖症

解析：骨纤维异样增殖症则为发育畸形，发病年龄较早，病期较长，以上颌骨为多见，常为多发性。在X线片上表现为颌面骨广泛性或局限性沿骨长轴方向发展，呈不同程度的弥散性膨胀，病变与正常骨之间无明显界限。其密度根据病变中含骨量多少而异，有的呈密度高低不等阴影，有的呈毛玻璃状，少数表现为多房性囊状阴影。掌握“骨化纤维瘤”知识点。